通过竞争性地与α-葡萄糖苷酶结合而抑制其活性的降血糖药物是
A. 马来酸罗格列酮
B. 瑞格列奈
C. 格列本脲
D. 甲苯磺丁脲
E. 阿卡波糖

正确答案：E。阿卡波糖

解析：本题考查阿卡波糖。α-葡萄糖苷酶抑制剂的化学结构均为单糖或多糖类似物，主要有阿卡波糖（E对）、米格列醇和伏格列波糖，可竞争性地与α-葡萄糖苷酶结合，抑制该酶的活性，从而减慢糖类水解产生葡萄糖的速度，并延缓葡萄糖的吸收。马来酸罗格列酮（A错）属于胰岛素增敏剂。瑞格列奈（B错）、格列本脲（C错）、甲苯磺丁脲（D错）均属于胰岛素分泌促进剂。